猪苓的主产地之一是
A. 陕西
B. 山西
C. 安徽
D. 四川
E. 贵州

正确答案：A。陕西

解析：本题考查的是猪苓的产地。猪苓的主产地之一是陕西（A对）。猪苓：【产地】主产于陕西和云南省。已有人工栽培。主产于山西（B错）的药材有苦参、远志、党参、香加皮、蒲公英、连翘、硫黄等。主产于安徽（C错）的药材有南沙参、桑白皮、牡丹皮、菊花、木瓜、决明子、大蓟、茯苓等。主产于四川（D错）的药材为川药。川药：主产地四川、西藏等。如川贝母、川芎、黄连、川乌、附子、麦冬、丹参、干姜、白芷、天麻、川牛膝、川楝子、川楝皮、川续断、花椒、黄柏、厚朴、金钱草、五倍子、冬虫夏草、麝香等。主产于贵州（E错）的药材为贵药。贵药：主产地贵州。如天冬、天麻、黄精、杜仲、吴茱萸、五倍子、朱砂等。